呼吸衰竭的血气诊断标准是
A. 动脉血氧含量低于9mmol/L
B. 动脉血氧饱和度（SaO₂）低于90%
C. pH值＜7.35
D. 动脉血二氧化碳分压（PaCO₂）高于50mmHg
E. 动脉血氧分压（PaO₂）低于60mmHg

正确答案：E。动脉血氧分压（PaO₂）低于60mmHg

解析：呼吸衰竭是指各种原因引起的肺通气和（或）肺换气功能严重障碍，使静息情况下亦不能维持足够的气体交换，导致低氧血症（伴或不伴）高碳酸血症，进而引起一系列病理生理改变和相应的临床表现的综合征，其临床表现缺乏特异性，明确诊断有赖于动脉血气分析：在海平面、静息状态、呼吸空气条件下，动脉血氧分压（PaO₂）＜60mmHg，伴或不伴二氧化碳分压（PaCO₂）＞50mmHg，可诊断为呼吸衰竭”（E对）。动脉血氧含量低于9mmol/L（A错）、动脉血氧饱和度（SaO₂）低于90%（B错）、pH值＜35（C错）、动脉血二氧化碳分压（PaCO₂）高于50mmHg（D错）均不是呼吸衰竭血气诊断标准。